对糖尿病患者进行术前准备，说法正确的是
A. 禁食患者需维持血糖轻度升高状态
B. 能以饮食控制病情者还需应用降糖药
C. 口服长效降糖药者需在术前一天停药
D. 平时应用胰岛素者，术晨不能停用
E. 酮症酸中毒患者无需处理，可接受急症手术

正确答案：A。禁食患者需维持血糖轻度升高状态

解析：糖尿病患者术前准备：禁食患者需维持血糖轻度升高状态（A对），这样既不至于因胰岛素过多而发生低血糖，也不至于因胰岛素过少而发生酮症酸中毒；能以饮食控制病情者，无需使用降糖药（B错）；口服长效降糖药，应在术前2至3天停药（C错）；平时应用胰岛素者，在手术日晨停用胰岛素（D错）；酮症酸中毒患者，需要急症手术，尽可能纠正酸中毒、血容量不足、电解质失衡（特别是低钾血症）（E错）。